浓缩丸的制备可选用
A. 滴制法
B. 热熔法
C. 乳化法
D. 塑制法
E. 压灌法

正确答案：D。塑制法

解析：本题考查的是浓缩丸的制备方法。浓缩丸的制备可选用塑制法（D对）。浓缩丸：系指饮片或部分饮片提取浓缩后，与适宜的辅料或其余饮片细粉，以水、炼蜜或炼蜜和水为黏合剂制成的丸剂。根据所用黏合剂的不同，分为浓缩水丸、浓缩蜜丸和浓缩水蜜丸。按制法不同，丸剂可分为泛制丸、塑制丸与滴制丸。①泛制丸：系指药物细粉以适宜液体为润湿剂或黏合剂泛制而成的圆球形制剂，如水丸及部分水蜜丸、浓缩丸、糊丸等。②塑制丸：系指药物细粉与适宜黏合剂混合制成的可塑性丸块，经制丸机或丸模制成的丸剂，如蜜丸及部分糊丸、浓缩丸等。③滴制丸（滴丸）：用滴制法（A错）制成的丸剂，系指原料药与适宜的基质加热熔融混匀，滴入不相混溶、互不作用的冷凝介质中制成的球形或类球形制剂。热熔法（B错）为双黄连栓剂的制备方法。乳化法（C错）为乳剂的制备方法。乳剂系指两种互不相溶的液体，经乳化制成的一种液体以液滴状态分散于另一相液体中形成的非均相分散体系的液体制剂。压灌法（E错）为将气雾剂的抛射剂装入容器的方法。